与CCMD-3最接近的分类诊断标准是
A. ICD-9
B. ICD-10
C. DSM-Ⅲ
D. DSM-Ⅲ-R
E. DSM-Ⅳ

正确答案：B。ICD-10

解析：CCMD-3（中国精神障碍分类与诊断标准）与ICD-10（疾病及有关保健问题的国际分类）的分类诊断标准最接近。CCMD-3（中国精神障碍分类与诊断标准）沿用了ICD-10（疾病及有关保健问题的国际分类）的诊断标准（B对）。 CCMD-3（中国精神障碍分类与诊断标准）与ICD-10（疾病及有关保健问题的国际分类）的分类诊断标准最接近。CCMD-3（中国精神障碍分类与诊断标准）沿用了ICD-10（疾病及有关保健问题的国际分类）的诊断标准（B对）。